将噻吗洛尔（pKₐ9.2，lgP=-0.04）制成丁酰噻吗洛尔（lgP=2.08）的目的是
A. 改善药物的水溶性
B. 提高药物的稳定性
C. 降低药物的毒副作用
D. 改善药物的吸收性
E. 增加药物对特定部位作用的选择性

正确答案：D。改善药物的吸收性

解析：本题考查药物的理化性质与药物活性。将噻吗洛尔制成脂溶性较高的丁酰噻吗洛尔的目的是改善其吸收性（D对）。药物的脂溶性与水溶性影响药物的吸收，当二者比例适当时，才有利于吸收。噻吗洛尔为β受体拮抗剂，常用于治疗青光眼和降低眼压，由于其极性较强（pKₐ9.2）和脂溶性差（lgP=-0.04），难于透过眼角膜，将噻吗洛尔制成丁酰噻吗洛尔后其脂溶性增高（lgP=2.08），制成滴眼剂透过角膜的能力增加了4～6倍，进入眼球后，经酶水解再生成噻吗洛尔发挥作用，因此将噻吗洛尔制成脂溶性较高的丁酰噻吗洛尔的目的是改善其吸收性。